形成血浆胶体渗透压的主要物质是
A. NaCl
B. 清蛋白
C. 球蛋白
D. 纤维蛋白
E. 血红蛋白

正确答案：B。清蛋白